不应给怀孕头3个月妇女使用的药品有
A. 环磷酰胺
B. 雌激素
C. 盐酸米诺环素
D. 叶酸
E. 硫酸亚铁

正确答案：A、B、C。环磷酰胺；雌激素；盐酸米诺环素

解析：本题考查特殊人群用药。不应给怀孕头3个月妇女使用的药品有环磷酰胺（A对）、雌激素（B对）、盐酸米诺环素（C对）。环磷酰胺有致突变或致畸胎作用，可造成胎儿死亡或先天性畸形。在妊娠早期服用雌激素可引起胎儿性发育异常。盐酸米诺环素对胎儿具有致畸作用。叶酸（D错）是胎儿生长发育不可缺少的营养素。硫酸亚铁（E错）对孕妇补充铁离子具有较好作用。